男，45岁。疲乏贫血4个月入院。既往有乙型肝炎病史10年，查体：睑结膜略苍白，腹软。可见腹壁静脉曲张，肝肋下未触及，脾脏肿大，移动性浊音阳性，血Plt50×10⁹/L。血小板减少最可能的原因是
A. 营养不足
B. 溶血
C. 骨髓抑制
D. 脾功能亢进
E. 出血

正确答案：D。脾功能亢进

解析：本例患者中年男性，疲乏贫血4个月，既往有乙型肝炎病史10年（肝硬化的高危人群）。查体：睑结膜略苍白（提示贫血），腹壁静脉曲张（提示门-腔侧支循环开放），脾脏肿大，移动性浊音阳性（提示有腹水）。实验室检查：血小板50×10⁹/L（正常值为100～300×10⁹/L，提示血小板减少）。综合患者的病史、查体、实验室检查考虑患者为肝硬化失代偿期。肝硬化失代偿期表现为肝功能减退和门脉高压症，门脉高压症表现为脾大功能亢进、侧支循环开放和腹水。该患者血小板减少最可能的原因是脾功能亢进（D对）。脾功能亢进可以引起全血细胞减少，其中红细胞减少为溶血（B错）。肝硬化肝功能减退时可出现营养不良（A错），但营养不良不会导致血小板减少。肝硬化门静脉高压引起肝硬化患者一般不会出现骨髓抑制（C错）。虽然出血（E错）可引起血小板减少，但题干未出现出血的相关描述。